医德范畴审慎主要是指
A. 对自己行为是否符合道德准则的自我评价
B. 医务人员理性上自尊的表现
C. 对患者高度负责的精神和严谨的科学作风
D. 医务人员在道德上应该履行的职责
E. 医务人员对自己和他人行为之间关系的内心体验

正确答案：C。对患者高度负责的精神和严谨的科学作风

解析：医德范畴审慎主要是指对患者高度负责的精神和严谨的科学作风。包括言语审慎和行为审慎。言语审慎：“语言能治病，也能致病”。因为一个人生病后其身心状态、生活方式和社会适应能力等都会发生改变，常常对医务人员的语言特别敏感。医务人员温馨的语言，使病人有温暖感和心情愉快，有助于配合医护而早日康复。若医务人员的语言简单、粗暴、尖刻等，就会对病人造成恶性刺激，从而影响医疗和护理，甚至造成病人的疾病恶化。因此，在医护活动中，医务人员的言语要审慎，提倡语言美，并使语言具有治疗性。②行为审慎：在医学实践活动的各个环节，医务人员要自觉做到认真负责，行为谨慎，一丝不苟医学`教育网搜集整理。同时，还要严格地遵守规章制度和操作规程，因为它们是保证医学实践活动正确、安全、有效的措施，也是审慎的内容（C对）。